牙周探诊除了测量袋的深度外，还应探查的是
A. 牙龈是否出血
B. 龈下牙石的量和分布
C. 根分叉是否受累
D. 龈缘的位置
E. 以上均是

正确答案：E。以上均是

解析：本题考查牙周探诊的目的。牙周探诊主要包括龈沟或牙周袋深度及附着水平，牙周袋的类型及分布；探诊后牙龈是否出血（A对）；袋的内容物，包括龈下牙石的量和分布（B对）；根分叉是否受累（C对）；同时应检查龈缘的位置（D对）即有无牙龈退缩或增生肿胀。（ABCD均对，故E为本题的正确答案）。